可引起巨幼细胞贫血的药物是
A. 氯喹
B. 奎宁
C. 伯氨喹
D. 乙胺嘧啶
E. 甲氟喹

正确答案：D。乙胺嘧啶